能体现人体实验科学原则的是
A. 以健康人或病人作为受试对象
B. 实验时使用对照和双盲法
C. 不选择弱势人群作为受试者
D. 实验中受试者得到专家的允许后可自由决定是否退出
E. 弱势人群若参加实验，需要监护人的签字

正确答案：B。实验时使用对照和双盲法

解析：人体实验的基本伦理准则：①人体实验必须合理保护受试者利益②人体实验必须经过受试者知情同意③人体实验必须恪守严谨的学风，实验的全过程都严格遵循医学科学原理，采用实验对照和双盲等方法（B对），体现了人体实验科学原则。缺乏或丧失知情同意能力的弱势人群若参加实验，需要监护人的签字（E错），体现人体实验知情同意的伦理原则。